治疗虚劳肺阴虚证，应首选
A. 六味地黄丸
B. 玉女煎
C. 左归丸
D. 沙参麦冬汤
E. 麦门冬汤

正确答案：D。沙参麦冬汤

解析：沙参麦冬汤功能滋养肺阴，清热润燥，最宜治疗肺阴虚证（D对）。六味地黄丸，其功用为滋补肝肾，可用于下消之肾阴亏虚证（A错）。玉女煎，其功用为清胃滋阴，可用于中消、胃热炽盛证(B错)。左归丸，其功用为滋阴补肾，填精益髓，适用于真阴不足证（C错）。麦门冬汤，其功用为滋阴养胃，降逆止呕，可用于呕吐之胃阴不足证（E错）。